牛乳中的蛋白质主要是
A. 乳清蛋白
B. 酪蛋白
C. 胶原蛋白
D. 黏蛋白
E. 乳球蛋白

正确答案：B。酪蛋白

解析：本题考查牛乳中的蛋白质主要成分。牛乳蛋白质主要由酪蛋白（79.6%）、乳清蛋白（11.5%）和乳球蛋白（3.3%）组成，其主要成分是酪蛋白（B对ACDE错）。